某药厂生产的清开灵注射液，其药物组成包括胆酸、珍珠母（粉）、猪去氧胆酸、栀子、水牛角（粉）、板蓝根、黄芩苷、金银花、附加剂为依地酸二钠、硫代硫酸钠、甘油。具有清热解毒、化瘀通络、醒神开窍。处方中胆酸的化学结构类型属于
A. 二萜
B. 黄酮
C. 蒽醌
D. 香豆素
E. 甾体

正确答案：E。甾体

解析：本题考查的是胆酸的化学结构类型。处方中胆酸的化学结构类型属于甾体（E对）。胆酸属于胆汁酸类化合物。天然胆汁酸是胆烷酸的衍生物，胆烷酸的结构中有甾体母核。胆汁酸的分布较广，从动物的胆汁中发现的胆汁酸超过100种，其中最常见的不过几种，如胆酸、去氧胆酸、猪去氧胆酸、鹅去氧胆酸、熊去氧胆酸等。常见的含胆汁酸的中药有牛黄、熊胆等。二萜（A错）：多以树脂、内酯或苷的形式广泛存在于自然界。不少二萜含氧衍生物具有很好的生物活性，如穿心莲内酯、芫花酯、雷公藤内酯、银杏内酯、紫杉醇等。黄酮（B错）：黄酮类化合物广泛存在于自然界中。多存在于高等植物及羊齿类植物中。含黄酮类的中药有黄芩、葛根、银杏叶、槐花、陈皮、满山红等。蒽醌（C错）：蒽醌类成分包括蒽酮及其不同还原程度的产物。含有蒽醌的中药有大黄、虎杖、茜草等。香豆素（D错）：香豆素是邻羟基桂皮酸的内酯，广泛分布于高等植物中，尤其以芸香科和伞形科为多，少数发现于动物和微生物。在植物体内，它们往往以游离状态或与糖结合成苷的形式存在。